关于生物性有毒有害物质的描述正确的是
A. 生物性有毒有害物质主要表现为急性毒性
B. 生物性有毒有害物质主要表现为神经毒性
C. 有些植物的花粉可引起过敏症
D. 生物性有毒有害物质主要表现为致癌性
E. 生物性有毒有害物质主要表现为致畸性

正确答案：C。有些植物的花粉可引起过敏症

解析：本题考查生物性有毒有害物质的相关内容。某些植物（包括观赏性植物）可引起变应性接触性皮炎，许多植物的花粉可引起过敏症（C对ABDE错）。花粉过敏症是一种危害人体健康的常见病和继发病，表现可划分为三大类：花粉性鼻炎、花粉性哮喘、花粉性结膜炎。